含鞣质中药乙醇提取液回收乙醇后溶于水。要使鞣质自水溶液中沉淀析出，可选用的方法是
A. 加数倍丙酮
B. 加数倍乙醚
C. 加明胶溶液
D. 加NaCl盐析
E. 加咖啡碱溶液

正确答案：B、C、E。加数倍乙醚；加明胶溶液；加咖啡碱溶液

解析：本题考查的是鞣质的理化性质。含鞣质中药乙醇提取液回收乙醇后溶于水。要使鞣质自水溶液中沉淀析出，可选用的方法是加数倍乙醚（B对）、加明胶溶液（C对）或加咖啡碱溶液（E对）。鞣质的溶解性：鞣质具有较强的极性，可溶于水、甲醇、乙醇、丙酮（A错）等亲水性溶剂，也可溶于乙酸乙酯，难溶于乙醚、三氯甲烷等亲脂性溶剂。鞣质与蛋白质作用：鞣质可与蛋白质结合生成不溶于水的复合物沉淀。实验室一般使用明胶进行鉴别、提取和除去鞣质。鞣质与生物碱作用：鞣质为多元酚类化合物，具有酸性，可与生物碱结合生成难溶于水的沉淀。常作为生物碱的沉淀反应试剂。加NaCl盐析（D错）不能使鞣质自水溶液中沉淀析出。